某儿，孕36周出生，体重2kg，体温34摄氏度。活动少，不能吸吮，四肢、躯干、臀部及面颊均硬肿，呼吸困难，肺部出现细湿啰音。最可能的诊断是
A. 并发肺炎
B. 心力衰竭
C. 肺出血
D. 败血症
E. 呼吸衰竭

正确答案：C。肺出血